男性，29岁。转移性右下腹痛伴发热36小时入院，诊断为急性阑尾炎。急症行阑尾切除术，并给予大剂量抗生素治疗，术后5天，体温38.5℃，病人出现下腹坠痛。首选的检查方法是
A. 腹部B超
B. 盆腔CT
C. 直肠镜
D. 钡剂灌肠
E. 直肠指检

正确答案：E。直肠指检

解析：青年男性患者，因急性阑尾炎行阑尾切除术后5天，出现下腹坠痛（提示病变位于下腹部），体温38.5度（正常为36～37度，提示感染），结合患者病史、体查，应考虑为盆腔脓肿。为明确诊断，首选的检查方法是直肠指检（E对）。急性阑尾炎术后多采取斜坡卧位，此时盆腔位置最低，腹腔内的渗出液由于重力作用，易积聚在盆腔引起盆腔脓肿，主要表现为发热、直肠刺激征。直肠指诊操作简便，检查若发现肛管括约肌松弛，在直肠前壁触及向肠腔内膨起、有触痛和波动感的肿物，结合患者病史则可确立盆腔脓肿的诊断。B超检查（A错）可显示脓肿的位置和大小，有助于明确诊断，但由于操作相对较复杂，故不作为首选的检查方法。盆腔CT（B错）可明确脓肿的大小、部位，但由于价格昂贵，一般不作为首选的检查方法。直肠镜（C错）主要用于直肠肛管内病变（如肿瘤）的诊断，对盆腔脓肿的诊断价值不大。钡剂灌肠（D错）多用于评价有肠道有无梗阻及瘘道，对盆腔脓肿诊断意义不大。